结晶型二氧化硅主要见于
A. 玛瑙石
B. 花岗石
C. 大理石
D. 石英玻璃
E. 硅藻土

正确答案：B。花岗石